甲状腺
A. 由峡部和两个锥体叶组成
B. 质地较硬
C. 甲状腺被膜的内层称甲状腺真被膜
D. 甲状腺假被膜由颈浅筋膜构成
E. 以上均正确

正确答案：C。甲状腺被膜的内层称甲状腺真被膜

解析：甲状腺是人体最大的内分泌腺，为红褐色腺体，呈H形，由左、右侧叶和中间的甲状腺峡组成（A错），约50%的人甲状腺峡部向上伸出一锥状叶，长者可到达舌骨平面。甲状腺被气管前筋膜包裹（D错），该筋膜形成甲状腺假被膜，甲状腺真被膜是甲状腺被膜的内层（C对）。